流行病学研究是从
A. 个体水平研究疾病
B. 群体水平研究疾病
C. 分子水平研究疾病
D. 细胞水平研究疾病
E. 亚细胞水平研究疾病

正确答案：B。群体水平研究疾病